《中华人民共和国药品管理法》规定，对疗效不确、不良反应大或者其他原因危害人民健康的药品，应当
A. 进行再评价
B. 立即停止生产、经营、使用
C. 撤销其批准文号
D. 按假药处理
E. 按劣药处理

正确答案：C。撤销其批准文号

解析：本题考查《中华人民共和国药品管理法》。《中华人民共和国药品管理法》第四十二条规定，国务院药品监督管理部门对已经批准生产或者进口的药品，应当组织调查；对疗效不确、不良反应大或者其他原因危害人体健康的药品，应当撤销批准文号（C对）或者进口药品注册证书。